胸前憋闷，痛如针刺刀绞，面色灰滞，冷汗淋漓，证属
A. 气滞
B. 痰饮
C. 血虚
D. 肺热
E. 真心痛

正确答案：E。真心痛

解析：本题考查的是不同部位疼痛的临床意义。胸前憋闷，痛如针刺刀绞，面色灰滞，冷汗淋漓，证属真心痛（E对）。不同部位疼痛的临床意义：由于机体的各个部位总是与一定的脏腑经络相联系，所以分辨疼痛的部位，对于了解病变所在的脏腑经络也具有一定的意义。（1）头痛：头为诸阳之会，脑为髓之海，十二经脉与奇经八脉大都与头部有联系，尤其是三阳经，直接循行于头部。某些外感邪气，如风、寒、暑、湿、火以及痰浊、瘀血阻滞或上扰清阳，所引起的头痛多为实证。气血津液亏损，不能上荣于头，致使脑海空虚，也可以发生头痛，则属于虚证。凡头痛之在于经脉者，可根据经络的分布，以确定其病位之所在。如头项痛属太阳经，前额痛属阳明经，头侧痛属少阳经，头顶痛属厥阴经等。有时头疼常常伴有头晕，需要参考头晕的辨证特点。（2）胸痛：胸为心肺所居，故心肺的病变，如阳气不足、寒邪乘袭、瘀血阻滞、痰浊阻遏、火热伤络等，均可以导致胸部气机不畅，发生疼痛。胸闷痛而痞满者，多为痰饮（B错）；胸胀痛而走窜，嗳气痛减者，多为气滞（A错）；胸痛而咳吐脓血者，多见于肺痈；胸痛喘促而伴有发热、咳吐铁锈色痰者，多属肺热（D错）；胸痛、潮热、盗汗、痰中带血者，多属肺痨；胸痛彻背、背痛彻胸，多属心阳不振；痰浊阻滞的胸痹，如有胸前憋闷、痛如针刺刀绞，甚则面色灰滞、冷汗淋漓，则为“真心痛”。（3）脘痛：脘，指上腹，是胃所在部位，故又称“胃脘”。胃脘疼痛，可见于寒邪犯胃、食滞胃脘、肝气犯胃等病证。（4）胁痛：胁为肝胆二经分布的部位。如肝气不疏、肝火郁滞、肝胆湿热、血瘀气滞以及悬饮等病变，都可引起胁痛。（5）腹痛：腹部分大腹、小腹、少腹三部分。脐以上为大腹，属脾胃；脐以下为小腹，属肾、膀胱、大小肠及胞宫；小腹两侧为少腹，是肝经经脉所过之处。就其疼痛的不同部位，可以察知其所属的不同脏腑。对于腹痛，还需分清虚实，如寒凝、热结、气滞、血瘀、食滞、虫积等，多为实证；至于气虚、血虚（C错）、虚寒等，概属虚证。（6）腰痛：腰为肾之府，腰痛多见于肾的病变。因风、寒、湿邪阻塞经脉者，或瘀血阻络者均为实证；因于肾精气不足或阴阳虚损不能温煦、滋养而致者则为虚证。（7）四肢痛：四肢疼痛，或在关节，或在肌肉，或在经络，多由风寒湿邪的侵袭，阻碍气血运行所引起。亦有因于脾胃虚损、水谷精气不能运于四肢而发作。疼痛独见于足跟，甚则掣及腰脊者，多属肾虚。